以下不是舌乳头的是
A. 菌状乳头
B. 轮廓乳头
C. 软腭
D. 丝状乳头
E. 叶状乳头

正确答案：C。软腭

解析：本题考查舌乳头。软腭（C错，为本题的正确答案）属于被覆黏膜，与硬腭相延续，位于口腔顶部，不属于舌乳头。舌背黏膜表面有许多小突起，称为舌乳头。舌乳头分为丝状乳头（D对）、菌状乳头（A对）、轮廓乳头（B对）、叶状乳头（E对）。